男，14岁。右大腿深部巨大血管瘤，术后情况良好，伤口一期愈合。拆线后下床活动5分钟后，突然晕倒，抢救无效死亡。应考虑为
A. 脑血管意外
B. 心肌梗死
C. 休克致死
D. 肺动脉栓塞
E. 脂肪栓塞

正确答案：D。肺动脉栓塞

解析：静脉损伤，血流缓慢和血液高凝状态是造成深静脉血栓形成的三大因素。该患者右大腿深部巨大血管瘤（静脉损伤）、行手术治疗（血液高凝状态）、术后卧床（血流缓慢），存在深静脉血栓形成的三大因素，拆线后下床活动，静脉血栓可脱落并随血液运动到肺动脉堵塞，造成血液阻塞、血液动力学的变化，进而出现血压下降、休克和心脏衰竭，甚至造成死亡（D对C错）。青年男性患者，既往无高血压、冠心病等心血管病史，故不考虑脑血管意外、心肌梗死（AB错）。脂肪栓塞的栓子常来源于长骨骨折，脂肪组织严重挫伤和烧伤，临床表现上，多在损伤后1-3天内出现突然发性作的呼吸急促、呼吸困难和心动过速，该患者拆线后下床活动（下肢拆线时间为术后10～12天），无形成脂肪栓子的条件（E错）。